某男，86岁。口干，但欲漱水不欲咽，其临床意义是
A. 瘀血阻滞
B. 津液不足
C. 热入营血
D. 热盛伤津
E. 痰饮内停

正确答案：A。瘀血阻滞

解析：本题考查口渴与饮水异常变化的临床意义。口干，但欲漱水不欲咽，其临床意义是瘀血阻滞（A对）。口渴与饮水异常变化的临床意义：一般地说，口渴多饮，常见于热证，大渴喜冷饮，为热盛伤津（D错）；渴喜热饮，饮量不多或口渴欲饮，水入即吐，小便不利，多为痰饮内停（E错）、水津不能上承之证；口渴而不多饮，常见于急性热病，多属热入营血（C错）；口干，但欲漱水不欲咽，常见于瘀血；大渴引饮，小便量多，是为消渴。津液不足（B错）证的临床表现及辨证要点：津液不足证的临床表现，常见口渴咽干，唇燥舌干少津或无津，皮肤干燥，甚或干瘪，或见下肢痿弱，或小便短少，大便干结，脉多细数。若因高热灼伤津液，并见心烦、渴饮、舌红、苔黄、脉细数等症状。若气阴两伤，则并见气短、神疲、舌色较淡、苔少或光剥无苔、脉虚无力的症状。多以皮肤、口唇、舌咽干燥及尿少便干为辨证要点。